血浆晶体渗透压降低时可引起
A. 红细胞膨胀和破裂
B. 红细胞萎缩
C. 组织液增多
D. 组织液减少
E. 尿少

正确答案：A。红细胞膨胀和破裂